某女，58岁。患暑湿感冒，症见发热头痛、腹痛腹泻、恶心呕吐、肠胃不适。治当解表、祛湿、和中，宜选用的中成药是
A. 参苏丸
B. 甘露消毒丸
C. 荆防颗粒
D. 保济丸
E. 十滴水

正确答案：D。保济丸

解析：本题考查保济丸的功能和主治。治当解表、祛湿、和中，宜选用的中成药是保济丸（D对）。保济丸（口服液）【功能】解表，祛湿，和中。【主治】暑湿感冒，症见发热头痛、腹痛腹泻、恶心呕吐、肠胃不适；亦可用于晕车晕船。参苏丸（A错）（胶囊）【功能】益气解表，疏风散寒，祛痰止咳。【主治】身体虚弱，感受风寒所致的感冒，症见恶寒发热、头痛鼻塞、咳嗽痰多、胸闷呕逆、乏力气短。甘露消毒丸（B错）【功能】芳香化湿，清热解毒。【主治】暑湿蕴结，身热肢酸、胸闷腹胀、尿赤黄疸。荆防颗粒（C错）【功能】解表散寒，祛风胜湿。【主治】外感风寒挟湿所致的感冒，症见头身疼痛、恶寒无汗、鼻塞流涕、咳嗽。十滴水（E错）【功能】健胃，祛暑。【主治】中暑，症见头晕、恶心、腹痛、胃肠不适。